根据《中华人民共和国药品管理法》，化学药品购销记录必须注明药品的
A. 通用名称
B. 常用名称
C. 化学名称
D. 商品名称
E. 英文名称

正确答案：A。通用名称

解析：本题考查药品经营。根据《中华人民共和国药品管理法》，化学药品购销记录必须注明药品的通用名称（A对）。《中华人民共和国药品管理法》第五章药品经营第五十七条：药品经营企业购销药品，应当有真实、完整的购销记录。购销记录应当注明药品的通用名称、剂型、规格、产品批号、有效期、上市许可持有人、生产企业、购销单位、购销数量、购销价格、购销日期及国务院药品监督管理部门规定的其他内容。